患者，男，66岁。小便滴沥不爽，排出无力，甚则点滴不通，精神疲惫，兼见面色晄白，腰膝酸软，畏寒乏力，舌质淡，脉沉细而弱。治疗除取主穴外，还应选用的是
A. 太溪、复溜
B. 曲骨、委阳
C. 太冲、大敦
D. 中极、膀胱俞
E. 血海、三阴交

正确答案：A。太溪、复溜

解析：题中患者以小便滴沥不爽，排出无力，甚则点滴不通为主症，故诊断为癃闭。面色㿠白，腰膝酸软，畏寒乏力，舌质淡，脉沉细而弱均为肾阳虚衰之象，故辨为肾阳虚证。太溪能滋肾壮阳，复溜穴能补肾温阳利水，可用于治疗癃闭肾气亏损证（A对）。委中配曲池能治疗癃闭湿热内蕴证，曲骨配血海能治疗癃闭瘀血阻滞证（B错）。太冲、大敦用于治疗癃闭肝郁气滞证（C错）。中极、膀胱俞为癃闭实证的主穴（D错）。血海、三阴交用于治疗癃闭瘀血阻滞证（E错）。